关于鼓室，正确的描述是
A. 鼓室即中耳
B. 是与外界不通的小腔
C. 由4个壁围成
D. 鼓室内有3块听小骨
E. 无

正确答案：D。鼓室内有3块听小骨

解析：鼓室是中耳的组成部分（A错）。鼓室借咽鼓管与鼻咽部相通（B错）。鼓室由6个壁组成（C错）。鼓室内有锤骨、砧骨和镫骨3块听小骨（D对）。